通过阻断α₁受体而降低血压的药物是
A. 卡托普利
B. 硝苯地平
C. 可乐定
D. 哌唑嗪
E. 普萘洛尔

正确答案：D。哌唑嗪

解析：本题考查哌唑嗪。通过阻断α₁受体而降低血压的药物是哌唑嗪（D对）。哌唑嗪选择性阻滞血管平滑肌突触后膜的α₁受体，使小动脉、小静脉扩张而产生中等偏强的降压作用。卡托普利（A错）为血管紧张素转换酶抑制剂（ACEI）。硝苯地平（B错）是钙通道阻滞剂。可乐定（C错）是中枢性降压药。普萘洛尔（E错）是β受体阻断药。